女，67岁，车祸后即昏迷，伤后2小时被送至医院。查体：昏迷状态，左顶枕部有一直径4cm头皮血肿，右侧瞳孔散大，对光反射消失，左侧肢体肌张力增高，病理反射阳性。头颅CT示右额颞部骨板下新月形高密度影。需要立即采取的治疗措施是
A. 气管切开
B. 冬眠疗法
C. 颅内血肿清除
D. 激素治疗
E. 止血，抗感染

正确答案：C。颅内血肿清除

解析：老年女性患者，车祸后持续昏迷，左顶枕部有一头皮血肿（提示右额颞部对冲伤），右侧瞳孔散大，对光反射消失（提示右侧动眼神经受压），左侧肢体肌张力增高，病理反射阳性（提示右侧小脑幕切迹疝），头颅CT示右额颞部骨板下新月形高密度影（急性硬膜下血肿的典型影像学表现），结合患者病史、临床表现和影像学检查，最可能的诊断为右额颞急性硬脑膜下血肿，小脑幕切迹疝。急性硬脑膜下血肿合并脑疝的患者应及时行开颅手术，清除颅内血肿（C对），以降低颅内压，缓解脑疝症状。气管切开（A错）可用于重度颅脑损伤的患者，以防治呼吸道分泌物潴留，保持呼吸道通畅，但不是首要治疗措施。冬眠疗法（可降低脑代谢，保护脑组织不致受缺氧、缺血的损害；减少脑血流量、减轻脑水肿，从而降低颅内压）（B错）、激素治疗（可减轻脑水肿）（D错）及止血、抗感染（E错）为颅内血肿的一般治疗措施，多作为术后的辅助治疗。